不能装在同一药斗中的是
A. 羌活、独活
B. 升麻、葛根
C. 当归、川芎
D. 制草乌、制川乌
E. 当归、独活

正确答案：E。当归、独活

解析：本题考查的是斗谱排列时还应参考的其他原则。不不能装在同一药斗中的是当归、独活（E对）。外观性状相似的饮片，尤其是外观形状相似但功效不同的饮片，不宜排列在一起。如蒲黄与海金沙，紫苏子与菟丝子，山药与天花粉，杏仁与桃仁，厚朴与海桐皮，荆芥与紫苏叶，大蓟与小蓟，炙甘草与炙黄芪，当归与独活，制南星与象贝（浙贝），菟丝子与苏子，熟地与黄精，知母与玉竹，蛇床子与地肤子，玫瑰花与月季花，血余炭与干漆炭，韭菜子与葱子等。羌活、独活（A错）与制草乌、制川乌（D错）常配伍使用，可同放。将同一处方中经常一起配伍应用的，如“相须”“相使”配伍的饮片、处方常用的“药对”药物可同放于一个斗中。如麻黄、桂枝；酸枣仁、远志；射干、北豆根；党参、黄芪；桃仁、红花；杜仲、续断；陈皮、青皮；泽泻、猪苓；山药、薏苡仁；板蓝根、大青叶；辛夷、苍耳子；火麻仁、郁李仁；羌活、独活；苍术、白术；麦冬、天冬；川乌、草乌；知母、浙贝母；蒲公英、紫花地丁；萹蓄、瞿麦；三棱、莪术；乳香、没药；小茴香、橘核。根据各医院、药房的实际情况和用药习惯，在实际编排斗谱时应灵活选择、应用上述原则，初步制定斗谱后，在实际工作中，可根据使用情况随时调整。升麻、葛根（B错）与当归、川芎（C错）为常用饮片，可同放。常用药物应放在斗架的中上层，便于调剂操作。如黄芪、党参与甘草；当归、白芍与川芎；麦冬、天冬与北沙参；肉苁蓉、巴戟天与补骨脂；金银花、连翘与板蓝根；防风、荆芥与白芷；柴胡、葛根与升麻；砂仁、豆蔻与木香；黄芩、黄连与黄柏；厚朴、香附与延胡索；焦麦芽、焦山楂与焦神曲；酸枣仁、远志与柏子仁；苦杏仁、桔梗与桑白皮；天麻、钩藤与蒺藜；陈皮、枳壳与枳实；附子、干姜与肉桂；山药、泽泻与牡丹皮等。